男性矿工，井下作业时发生塌方砸伤背部，当即倒于地上，下肢无力不能行走，立即来诊。检查见胸腰段后凸畸形并压痛，双下肢不全瘫。感觉异常平面位于双侧腹股沟水平。如果伤后3个小时，病人双下肢感觉、运动逐渐恢复，其最可能是
A. 脊髓水肿
B. 脊髓出血
C. 脊髓震荡
D. 脊髓挫伤
E. 脊髓受压

正确答案：C。脊髓震荡

解析：该患者被砸伤背部后，检查见胸腰段后凸畸形并压痛，双下肢不全瘫，感觉异常平面位于双侧腹股沟水平，说明脊柱骨折合并脊髓损伤。但患者伤后3个小时双下肢感觉、运动功能便开始恢复，伤后恢复较快，其最可能的诊断是脊髓震荡（C对）。脊髓震荡是脊髓受到强烈震荡后发生的超限抑制，脊髓功能处于生理停滞状态，但神经细胞结构正常，无形态学改变，故其伤后数小时至数天可恢复。脊髓水肿主要表现为伤后出现截瘫或不完全截瘫，脊髓出血主要表现为瘫肢肌张力降低、腱反射消失等脊髓休克表现，脊髓挫伤主要表现为截瘫或四肢瘫，脊髓水肿（A错）、脊髓出血（B错）和脊髓挫伤（D错）均表现为伤后恢复缓慢，而该患者伤后3小时开始恢复感觉及运动功能，与其表现不符。骨折移位、碎骨片与破碎的椎间盘挤入椎管内可以直接使脊髓受压（E错），使脊髓产生一系列脊髓损伤的病理变化，及时手术去除压迫物后脊髓的功能可望部分或全部恢复，而该患者未进行手术，双下肢感觉、运动便逐渐恢复，与其表现不符。